小建中汤中配伍芍药的意义是
A. 益阴养血，柔肝缓急
B. 养阴复脉，柔肝缓急
C. 益气养阴，缓急止痛
D. 益气养血，复脉定悸
E. 养阴补血，活血通脉

正确答案：A。益阴养血，柔肝缓急

解析：白芍的功效为养血敛阴，柔肝止痛，平抑肝阳。小建中汤是有桂枝汤倍芍药，重加饴糖组成。白芍为臣药，在方中有益阴养血，柔肝缓急的作用（A对）。记忆：小建中汤组成，桂枝汤倍芍药加饴糖。